下列说法正确的是
A. 在确定动物最大无作用剂量时，无须考虑受试动物的特殊毒性指标
B. 可耐受摄入量是指人类终生每日摄入该物质而对机体不产生任何已知不良效应的剂量
C. 对于非职业性接触者，食品不是有毒物质的主要来源
D. 食品中有毒有害物质的限量标准为食品中有毒物质的最小允许量
E. 食品容许限量越大越安全

正确答案：B。可耐受摄入量是指人类终生每日摄入该物质而对机体不产生任何已知不良效应的剂量